下列有关Kennedy第四类的基牙固位体选择，说法正确的是
A. 卡环可以是弯制的
B. 也可以是铸造的
C. 可利用基托与余留牙腭舌面的制锁作用
D. 可借助弹性塑料基板的弹性卡抱作用来固位
E. 以上说法均正确

正确答案：E。以上说法均正确

解析：基牙固位体选择：常选择双侧前磨牙设置固位间隙卡环，卡环可以是弯制的，也可以是铸造的。特殊情况下如缺牙少、美观要求髙者，可不设卡环，利用基托与余留牙腭舌面的制锁作用或借助弹性塑料基板的弹性卡抱作用来固位。掌握“局部义齿的设计”知识点。